属于相使的配伍是
A. 天南星配生姜
B. 甘草配甘遂
C. 石膏配牛膝
D. 丁香配郁金
E. 藜芦配白芍

正确答案：C。石膏配牛膝

解析：石膏配牛膝治胃火牙痛，石膏为清胃降火、消肿止痛的主药，牛膝引火下行，可增强石膏清火止痛的作用（C对）。相畏是一种中药的毒性或副作用能被另一种中药降低或消除，生姜可以抑制天南星的毒副作用（A错）。相反是两种中药同用能产生或增强毒性或副作用，如甘草反甘遂（B错）。十九畏是指：…丁香畏郁金（D错）。“十八反歌诀”最早见于金·张子和《儒门事亲》：“本草明言十八反，半蒌贝蔹及攻乌，藻戟遂芫俱战草，诸参辛芍叛藜芦。”藜芦反白芍（E错）。